首创六郁学说的医家是
A. 张仲景
B. 巢元方
C. 朱丹溪
D. 虞抟
E. 叶天士

正确答案：C。朱丹溪

解析：张仲景在《金匮要略·妇人杂病脉证并治》中记载了属于郁证的脏躁和梅核气两种病证，并观察到这两种病证多发于女性（A错）。巢元方在《诸病源候论·结气候》中指出忧思会导致气机郁结（B错）。朱丹溪在《丹溪心法·六郁》中将郁证列为一个专篇，提出了气、血、火、食、湿、痰六郁之说，并创立了六郁汤、越鞠丸等相应的治疗方剂（C对）。虞抟在《医学正传》中首先采用了郁证这一病证名称（D错）。叶天士在《临证指南医案·郁》中所载的病例，均属情志之郁，并注意到精神治疗对郁证具有重要意义（E错）。